由腹主动脉发出的单一脏支是
A. 胃左动脉
B. 脾动脉
C. 肝总动脉
D. 肠系膜上动脉
E. 肾动脉

正确答案：D。肠系膜上动脉

解析：胃左动脉（A错）、脾动脉（B错）和肝总动脉（C错）均为腹腔干的分支。肠系膜上动脉（D对）为腹主动脉发出的单一脏支。肾动脉（E错）为腹主动脉发出的成对脏支。